下列不参与肝生物转化第二相反应的酶是
A. 硫酸基转移酶
B. 谷胱甘肽-S-转移酶
C. 肽基转移酶
D. 葡糖醛酸基转移酶
E. 甲基转移酶

正确答案：C。肽基转移酶

解析：结合反应是生物转化的第二相反应，主要包括葡萄糖醛酸结合反应——由UDP-葡萄糖醛酸基转移酶催化（D错），硫酸结合反应——由硫酸基转移酶催化（A错），乙酰化反应——由乙酰基转移酶催化，谷胱甘肽结合反应——由谷胱甘肽S-转移酶催化（B错），甲基化反应——由胞质中可溶性儿茶酚胺-O-甲基转移酶催化（E错）。肽基转移酶与合成蛋白质相关（C对）。